降低同型半胱氨酸水平的是
A. 维生素B₂
B. 烟酸
C. 泛酸钙
D. 叶酸
E. 维生素C

正确答案：D。叶酸

解析：本题考查叶酸。降低同型半胱氨酸水平的是叶酸（D对）。维生素B₂（A错）为氧化还原酶的辅酶。烟酸（B错）可升高高密度脂蛋白胆固醇水平。维生素C（E错）可用于防治坏血病。